种植体周袋部位用氯己定冲洗的浓度是
A. 0.12%～0.2%
B. 0.16%～0.2%
C. 0.2%～0.5%
D. 0.4%～0.8%
E. 0.8%～0.12%

正确答案：C。0.2%～0.5%

解析：氯己定的应用：在探诊出血阳性，探诊深度4～5mm，有或无溢脓的种植体部位，除机械治疗外，还应使用氯己定治疗。每日用0.12%～0.2%氯己定含漱，种植体周袋部位用0.2%～0.5%氯己定龈下冲洗，或在感染部位局部应用0.2%氯己定凝胶。一般需3～4周的抗菌剂治疗，可获得治疗效果。掌握“种植体周围组织疾病”知识点。